咳嗽带有鸡鸣样吼声常见的疾病是
A. 喉炎
B. 极度虚弱病
C. 肺癌
D. 声带炎
E. 百日咳

正确答案：E。百日咳

解析：百日咳（E对）是一种由百日咳杆菌引起的急性呼吸道传染病，临床特征为咳嗽逐渐加重，呈典型的阵发性、痉挛性咳嗽，咳嗽带有鸡鸣样吼声。喉炎（A错）是指喉部黏膜的病菌感染或用声不当所引起的慢性炎症，咳嗽声音低沉、粗糙，晨起症状较重，随活动增加，咳出喉部分泌物而逐渐好转。极度虚弱患者（B错）常见于肿瘤引起的恶病质，咳嗽常无力，痰液不能排除，引起阻塞性肺炎。肺癌（C错）的患者咳嗽常呈金属调的咳嗽，是因为癌肿直接压迫器官所致。声带炎（D错）的咳嗽常嘶哑状咳嗽。